患者，女，46岁，出现潮热、出汗等症状。否认高血压、糖尿病及血栓栓塞性疾病史。不希望有月经样出血。宜选用的MHT方案是
A. 雌、孕激素连续联合方案
B. 单纯孕激素补充方案
C. 单纯雄激素补充方案
D. 单纯雌激素补充方案
E. 雌、孕激素序贯方案

正确答案：A。雌、孕激素连续联合方案

解析：本题考查绝经激素治疗（MHT）的常用治疗方案。雌、孕激素连续联合方案（A对）适用于有完整子宫、绝经后不希望有月经样出血的妇女。